危重病人突然头额冷汗大出，四肢厥冷，属于
A. 亡阴
B. 亡阳
C. 阳虚
D. 阴虚
E. 以上均非

正确答案：B。亡阳

解析：亡阳时阳气极度衰微，失去温煦、固摄、推动之能，故见冷汗，肢厥，面色苍白，神情淡漠，气弱，脉微等症状（B对）。亡阴指人体阴液严重耗损而欲竭，以汗出如油、身热烦渴、面赤唇焦、脉数疾为主要表现（A错）。阳虚证指人体阳气亏损，温养、推动等功能减退，以畏寒肢冷为主要表现（C错）。阴虚证指人体阴液亏少，滋润、濡养等功能减退，且无以制阳，阳气偏亢，以口咽干燥、五心烦热、潮热盗汗等为主要表现（D错）。